《素问•凋经论》说：“血有余”，则
A. 怒
B. 喜
C. 思
D. 悲
E. 恐

正确答案：A。怒

解析：本题是对经典原文的考查。《素问·调经论》说：“血有余则怒（A对），不足则恐。”